下列何种降血糖药易引起乳酸血症
A. 正规胰岛素
B. 阿卡波糖
C. 格列本脲
D. 甲苯磺丁脲
E. 苯乙福明

正确答案：E。苯乙福明

解析：国内常用双胍类降糖药物有二甲双胍（甲福明）和苯乙双胍（苯乙福明）。大剂量使用能引起吸收不良，导致维生素B12及叶酸缺乏，严重者可出现乳酸血症，酮血症。掌握“胰岛素、磺酰脲类及双胍类药”知识点。